下列应慎用含对乙酰氨基酚成分中成药的人群为
A. 肝肾功能不全者
B. 孕妇
C. 高血压
D. 糖尿病
E. 动脉硬化

正确答案：A。肝肾功能不全者

解析：本题考查的是西药组分中成药的使用注意事项。下列应慎用含对乙酰氨基酚成分中成药的人群为肝肾功能不全者（A对）。含西药组分中成药的使用注意事项：在使用含有西药成分中成药的时候，要注意不能再使用同种成分的西药或随意加大该中成药的剂量，以免重复用药或用药过量；同时也要注意和其他西药联用的药物相互作用，以防药物疗效降低及发生药物不良反应。1.含格列本脲成分的中成药：格列本脲可促进胰岛B细胞分泌胰岛素，抑制肝糖原分解和糖原异生，增加胰外组织对胰岛素的敏感性和糖的利用，可降低空腹血糖与餐后血糖。其常用量一般为每次2.5mg，3次/日。磺胺过敏、白细胞减少者禁用，孕妇（B错）及哺乳期妇女不宜使用，肝肾功能不全、体虚高热、甲状腺功能亢进者慎用。服用过量易致低血糖。2.含西药成分治疗感冒的中成药：患者在感冒发热时往往急于求愈，常常既服西药又服中药，或几种感冒药、退热药同服，若患者不了解所服每种药物的成分及其作用，加之目前西药解热镇痛药同物异名的情况很多，则易导致重复用药、过量用药。存在着严重的用药安全隐患。（1）含安乃近成分的中药的使用注意：安乃近多用于急性高热时退热，其退热作用强，易致患者大汗淋漓，甚至发生虚脱。长期应用可能引起粒细胞缺乏症、血小板减少性紫癫、再生障碍性贫血。因此，在服用含有安乃近成分的中成药时，切不可随意加大剂量，更不能长期使用，年老体弱者用药尤其应慎重，不能再同时加用西药解热药。因安乃近的代谢产物可进入乳汁，故哺乳期患者不宜应用。对安乃近、氨基比林及阿司匹林类药物过敏者禁用。（2）含对乙酰氨基酚成分的中成药：对乙酰氨基酚也称扑热息痛，是乙酰苯胺类解热镇痛药，可用于感冒或其他原因引起的高热和缓解轻中度疼痛，一般剂量较少引起不良反应。长期大量应用对乙酰氨基酚，尤其是肾功能低下时，可出现肾绞痛或急性肾功能衰竭、少尿、尿毒症。若与肝药酶诱导剂尤其是巴比妥类并用时，发生肝脏毒性反应的危险增加。肝肾功能不全的患者应慎用，有增加肝脏、肾脏毒性的危险。服用超量可出现恶心、呕吐、胃痛、胃痉挛、腹泻、多汗等症状。有不少中成药含有对乙酰氨基酚，若在治疗感冒发热使用这类中成药时再服用对乙酰氨基酚制剂，则使对乙酰氨基酚的剂量过大，增加药物的不良反应。（3）含马来酸氯苯那敏成分的中成药：氯苯那敏也称扑尔敏，常用其马来酸盐用于各种过敏性疾病，并与解热镇痛药配伍用于感冒，但有嗜睡、疲劳乏力等不良反应。因此在服药期间，不得驾驶车船、登高作业或操作危险的机器。3.含盐酸麻黄碱的中成药：麻黄碱虽然是中药麻黄中的一个主要成分，但是两者之间功效并非等同。盐酸麻黄碱有舒张支气管、加强心肌收缩力、增强心输出量的作用，并有较强的兴奋中枢神经作用，能收缩局部血管。对于前列腺肥大者可引起排尿困难，大剂量或长期应用可引起震颤、焦虑、失眠、头痛、心悸、心动过速等不良反应。故甲状腺功能亢进症、高血压（C错）、动脉硬化（E错）、心绞痛患者应禁用含盐酸麻黄碱的中成药。4.含吲哚美辛的中成药：吲哚美辛的不良反应发生率高达35%～50%，其中约20%的患者常因不能耐受而被迫停药。常见的不良反应包括如下几个方面。（1）胃肠道反应：如恶心、呕吐、厌食、消化不良、胃炎、腹泻，偶有胃溃疡、穿孔、出血。（2）中枢神经系统反应：头痛、眩晕、困倦，偶有惊厥、周围神经痛、晕厥、精神错乱等。（3）造血系统损害：可有粒细胞、血小板减少，偶有再生障碍性贫血。（4）过敏反应：常见为皮疹、哮喘、呼吸抑制、血压下降等。（5）可引起肝肾损害。鉴此，溃疡病、哮喘、帕金森病和精神病患者以及孕妇、哺乳期妇女禁用；14岁以下儿童一般不用；老年患者及心功能不全、高血压、肝肾功能不全、出血性疾病患者慎用；且不宜与阿司匹林、丙磺舒、钾盐、氨苯蝶啶合用。5.含氢氯噻嗪的中成药：氢氯噻嗪引起的不良反应最常见为低血钾，同时因其可抑制胰岛素释放，可使糖耐量降低、血糖升高，故肝肾疾病、糖尿病（D错）患者，孕妇及哺乳期妇女不宜服用。所以，使用含有氢氯噻嗪的中成药时，一方面要注意氢氯噻嗪本身所具有的不良反应，同时也要避免重复用药，以防止药物自身不良反应的发生。